未建立血液发放和输血核对制度的医疗机构,造成严重后果的应
A. 并予以警告
B. 进行通报批评
C. 可处3万元以下的罚款
D. 责令限期改正
E. 追究刑事责任

正确答案：C。可处3万元以下的罚款

解析：未尽临床用血管理职责的法律责任:医疗机构有下列情形之一的，由县级以上人民政府卫生行政部门责令限期改正；逾期不改的，进行通报批评，并予以警告；情节严重或者造成严重后果的，可处3万元以下的罚款，对负有责任的主管人员和其他直接责任人员依法给予处分：①未设立临床用血管理委员会或者工作组的；②未拟定临床用血计划或者1年内未对计划实施情况进行评估和考核的；③未建立血液发放和输血核对制度的；④未建立临床用血申请管理制度的；⑤未建立医务人员临床用血和无偿献血知识培训制度的；⑥未建立科室和医师临床用血评价及公示制度的；⑦将经济收入作为对输血科或者血库工作的考核指标的；⑧违反《医疗机构临床用血管理办法》的其他行为。掌握“医疗机构临床用血管理、及法律责任”知识点。